体内代谢时，由亚砜转化为硫醚而产生活性
A. 苯妥英
B. 氯霉素
C. 舒林酸
D. 利多卡因
E. 阿苯达唑

正确答案：C。舒林酸

解析：本题考查舒林酸。舒林酸（C对）属前体药物，它在体外无效，在体内经肝代谢，结构中甲基亚砜基被还原成甲硫基化合物而显示生物活性。苯妥英（A错）、氯霉素（B错）、利多卡因（D错）分子结构中均不含亚砜基。阿苯达唑（E错）系苯并咪唑类衍生物，结构中含有硫醚的结构，其在体内迅速代谢为亚砜、砜醇和2-胺砜醇，抗寄生虫的作用增强。